男，60岁。间断发热2周，尿黄伴乏力纳差1周，症状逐渐加重，出现恶心呕吐，既往体健，无肝病史，病前无饮酒服药史，病前3周曾去外地旅游。查体：神志清楚，皮肤巩膜黄染，肝肋下2cm，脾肋下刚触及，腹水征；实验室检査：ALT1500U/L，TBil80μmol/L。正确的处理不包括
A. 补充维生素
B. 卧床休息
C. 药物对症治疗
D. 抗病毒治疗
E. 清淡饮食

正确答案：D。抗病毒治疗

解析：60老年男性患者，既往体健，无肝病史，患者在3周前去外地旅游，间断发热2周，尿黄伴乏力纳差1周，症状逐渐加重，出现恶心呕吐（急性肝炎感染症状），病前无饮酒服药史（排除药物性肝损害、酒精性肝病），查体神志清楚，皮肤巩膜黄染，肝肋下2cm，脾肋下刚触及，腹水征；实验室检査ALT1500U/L（正常参考值0～40U/L），TBil80μmol/L（正常参考值3.4～17.1μmol/L），因各型急性肝炎的临床症状无特异性，结合患者既往史及外地旅史，及老年急性病毒性肝炎以戊型肝炎较多见（黄疸型为主），首先考虑的诊断是急性戊型肝炎；急性肝性一般为自限性，多可完全康复。以一般治疗及对症治疗对症治疗为主。急性期应隔离，症状明显及有黄疸者应卧床休息（B对），恢复期可增加活动量，但避免过度劳累。饮食宜清淡易消化（E对），适当补充维生素（A对）。辅以适当药物对症及恢复肝功（C对）。除急性丙型肝炎外，一般不采取抗病毒治疗（D错，为本题正确答案）。